下述情况可选用的灭菌方法是：氯霉素滴眼剂
A. 干热灭菌法
B. 热压灭菌法
C. 紫外线灭菌法
D. 滤过除菌
E. 流通蒸汽灭菌法

正确答案：E。流通蒸汽灭菌法